关于土壤孔隙对土壤性质的影响，错误的是
A. 土壤颗粒越小，容水量越大
B. 土壤颗粒越大，渗水性越强
C. 土壤颗粒越小，毛细管作用越差
D. 土壤容水量越大，透气性越差
E. 土壤颗粒越小，比表面越大

正确答案：C。土壤颗粒越小，毛细管作用越差

解析：本题考查土壤孔隙对土壤性质的影响。土壤的孔隙度指在自然状态下，单位容积土壤中孔隙容积所占的百分率。土壤孔隙对土壤性质有多方面的影响：1.土壤容水量：土壤颗粒越小，其孔隙总容积就越大（E对），容水量也越大（A对），土壤的渗水性和透气性不良（D对），不利于建筑物防潮和有机物的无机化；2.土壤渗水性：土壤颗粒越大，渗水越快（B对），土壤容易保持干燥。若渗水过快，地面污染物容易渗入地下水中，不利于地下水的防护；3.土壤的毛细管作用：土壤中的水分沿着孔隙上升的现象，称为土壤的毛细管作用。土壤孔隙越小其毛细管作用越大（C错，为本题正确答案）。